卡托普利的作用靶点是
A. 血管紧张素转化酶
B. β-肾上腺素受体
C. 羟甲戊二酰辅酶A还原酶
D. 钙离子通道
E. 钾离子通道

正确答案：A。血管紧张素转化酶

解析：本题考查卡托普利。卡托普利为血管紧张素转化酶（ACE）抑制剂，作用靶点即为血管紧张素转化酶（A对BCDE错）。